可增加分子的脂溶性，还会改变分子的电子分布，从而增强与受体的电性结合的基团是
A. 烃基
B. 卤素
C. 醚
D. 酰胺基
E. 羟基

正确答案：B。卤素

解析：本题考查药物官能团。卤素（B对）有较强的电负性，会产生电性诱导效应，卤素的引入可增加分子的脂溶性，还会改变分子的电子分布，从而增强与受体的电性结合，使生物活性发生变化。